休克病人中心静脉压为5cmH₂O，血压80/65mmHg，处理原则为
A. 适当补液
B. 使用强心药物
C. 用扩血管药
D. 补液试验
E. 充分补液

正确答案：D。补液试验

解析：患者中心静脉压正常（中心静脉压正常值为5～10cmH₂O），血压低（血压低于90/60mmHg即为低血压），提示心功能不全或血容量不足，此时的处理原则应为补液试验（D对），以进一步明确病因。补液试验是指取等渗盐水250ml，于5～10分钟内经静脉注入，若血压升高而中心静脉压不变，提示血容量不足，应补液（AE错）；若血压不变而中心静脉压升高3～5cmH₂O，则提示心功能不全，应使用强心药物（B错）、扩血管药（C错）。